对于牙本质过敏首选的治疗方法有
A. 药物脱敏
B. 牙髓治疗
C. 牙周洁治
D. 垫底充填
E. 树脂充填

正确答案：A。药物脱敏

解析：本题考查牙本质敏感症的治疗。牙本质过敏首选的治疗方法是药物脱敏（A对），若药物脱敏效果不佳，可采用充填治疗的方法进行处理（DE错）；若药物脱敏无效，患者感到非常痛苦，强烈要求治疗，且患牙数目较少者，可考虑人工冠修复，甚至牙髓治疗（B错）。若患牙同时存在牙周组织疾病，在治疗牙本质敏感的同时应作牙周洁治（C错）。